阳气不足，可发于五脏六腑，其最重要的是
A. 肾阳虚
B. 心阳虚
C. 肺阳虚
D. 肝阳虚
E. 脾阳虚

正确答案：A。肾阳虚

解析：阳气不足可见于五脏六腑，如心阳、脾阳和肾阳等，但一般以肾阳虚衰最为重要，因肾阳为人诸阳之本（A对BCDE错）。